女，30岁。乏力、头晕伴月经过多半年。化验：Hb60g/l，RBC3.1×10¹²/L，WBC7.3×10⁹/L，红细胞中心淡染区扩大。该患者最可能的化验结果是
A. 血清铁降低，总铁结合力降低，红细胞游离原卟啉降低
B. 血清铁降低，总铁结合力降低，红细胞游离原卟啉增高
C. 血清铁降低，总铁结合力增高，红细胞游离原卟啉增高
D. 血清铁增高，总铁结合力增高，红细胞游离原卟啉降低
E. 血清铁降低，总铁结合力增高，红细胞游离原卟啉降低

正确答案：C。血清铁降低，总铁结合力增高，红细胞游离原卟啉增高

解析：患者青年女性，月经过多病史（缺铁性贫血的原发病表现），乏力、头晕（贫血的表现）；化验：Hb60g/L（成年女性正常值110～150g/L），RBC3.1×10¹²/L（成年女性正常值3.5～5.0×10¹²/L），提示贫血，红细胞中心淡染区扩大，提示为小细胞低色素性贫血，故患者诊断为缺铁性贫血可能性大。缺铁性贫血患者由于合成血红蛋白的原料铁缺乏，会出现铁代谢指标异常，最可能的化验结果是贮存铁减少、血清铁降低、总铁结合力增高；由于细胞内缺铁，血红素合成障碍，大量原卟啉不能与铁结合为血红素，导致红细胞游离原卟啉增高（C对）。